某药物的生物半衰期是6.93h，表观分布容积是100L，该药物有较强的首过效应，其体内消除包括肝代谢和肾排泄，其中肾排泄占总消除的20%，静脉注射该药200mg的AUC是20㎍·h/ml，将其制备成片剂用于口服，给药100mg后的AUC为10㎍·h/ml。该药物的肌酐清除率
A. 2L/h
B. 6.93L/h
C. 8L/h
D. 10L/h
E. 55.4L/h

正确答案：C。8L/h

解析：本题考查清除率。清除率公式为Cl=kV，清除率具有加和性，Cl=Clh+Clr，K=0.693/t1/2=0.693/6.93=0.1；代入数值Cl=kV=0.1×100=10L/h，又有肾排泄占消除率20%，所以肝占80%，10×80%=8L/h（C对）。